威灵仙的功效是
A. 祛风湿，通经络，利小便
B. 祛风湿，通经络，降血压
C. 祛风湿，通经络，安神志
D. 祛风湿，通经络，消痰水
E. 祛风湿，通经络，化瘀血

正确答案：D。祛风湿，通经络，消痰水

解析：本题考查的是威灵仙的功效。威灵仙的功效是祛风湿，通经络，消痰水（D对）。威灵仙：【功效】祛风湿，通经络，消痰水，治骨鲠。青风藤：【功效】祛风湿，通经络，利小便（A错）。臭梧桐：【功效】祛风湿，通经络，降血压（B错）。功效为祛风湿，通经络，安神志（C错）或祛风湿，通经络，化瘀血（E错）的中药，2022年考试指南未明确说明。